迷、躁动，右侧瞳孔直径约5mm，左侧3mm；对光反射：左侧存在，右侧消失。左侧肌力3级，右侧肌力5级。左枕部头皮血肿，颈项强直。最主要的诊断是
A. 右额急性硬脑膜下血肿伴左小脑幕切迹疝
B. 右额急性硬脑膜下血肿伴右小脑幕切迹疝
C. 左额广泛脑挫裂伤伴左小脑幕切迹疝
D. 左额急性硬脑膜下血肿伴左小脑幕切迹疝
E. 左额急性硬脑膜下血肿伴右小脑幕切迹疝

正确答案：B。右额急性硬脑膜下血肿伴右小脑幕切迹疝

解析：根据颅脑对冲伤的受伤机制（损伤发生在着力部位的对侧），患者左枕部着地导致右额颞叶损伤（DE错），受伤后立即昏迷，没有中间清醒期（硬脑膜下血肿多表现为持续昏迷），喷射状呕吐3次（颅内高压表现），右侧瞳孔直径约4mm，左侧2mm，右侧对光反射消失（瞳孔正常直径3~4mm，小脑幕切迹疝患侧瞳孔缩小常为一过性，不易观察到，随病情进展患侧动眼神经麻痹，患侧瞳孔逐渐散大，直接和间接对光反射均消失）考虑为右侧小脑幕切迹疝，左侧肌力3级，右侧肌力5级（病变对侧肢体的肌力减弱或麻痹）（AC错）。故诊断为右额急性硬脑膜下血肿伴右小脑幕切迹疝（B对）。